不是舍格伦综合征唾液腺造影表现的是
A. 腺体形态正常，排空功能迟缓
B. 唾液腺末梢导管扩张
C. 向心性萎缩
D. 离心性萎缩
E. 肿瘤样改变

正确答案：D。离心性萎缩

解析：本题考查舍格伦综合征。不是舍格伦综合征唾液腺造影表现的是离心性萎缩（D错，为本题正确答案）。舍格伦综合征唾液腺造影表现分为以下4型：1.腺体形态正常，排空功能迟缓。2.唾液腺末梢导管扩张。3.向心性萎缩。4.肿瘤样改变。